完整的处方应该包括
A. 医院的名称、就诊科室、就诊日期
B. 患者姓名、性别、年龄、临床诊断
C. 药品的名称、剂型、规格、数量和用法
D. 处方前记、处方正文和处方后记
E. 医师、配方人、核对人、发药人的签名

正确答案：D。处方前记、处方正文和处方后记

解析：本题考查处方。完整的处方包括三部分，即处方前记、处方正文和处方后记（D对）。医院的名称、就诊科室、就诊日期（A错），患者姓名、性别、年龄、临床诊断（B错）均属于处方前记。药品的名称、剂型、规格、数量和用法（C错）是处方正文的内容。医师、配方人、核对人、发药人的签名（E错）属于处方后记。